二度Ⅰ型房室传导阻滞的心电图特征是
A. P-R间期进行性缩短，直至一个P波受阻不能下传到心室
B. 相邻R-R间距进行性延长，直至一个P波受阻不能下传到心室
C. P-R间期进行性延长，直至一个P波受阻不能下传到心室
D. P-R间期>0.20秒，P波下传无受阻
E. P-R间期固定，P波间断受阻不能下传到心室

正确答案：C。P-R间期进行性延长，直至一个P波受阻不能下传到心室

解析：二度Ⅰ型房室传导阻滞的心电图特点是窦性P波规律出现。文氏现象：PR间期呈进行性延长，RR间距逐渐缩短，直至出现一次心室漏搏。心室漏搏所致的最长RR间距短于任何2个最短的RR间距之和。漏搏后，房室阻滞得到一定改善，PR间期又缩短，之后又逐渐延长，如此周而复始地出现。房室传导比例常为3∶2、4∶3、5∶4等（C对AB错）。一度房室传导阻滞心电图特点为窦性P波之后均伴随QRS波群。PR间期延长：PR间期≥0.21s儿童>0.18s，老年人>0.22s；或 PR间期超过相应年龄和心率的正常最高值；或在心率未变的情况下PR间期较原来延长0.04s 以上（D错）。二度Ⅱ型房室传导阻滞的心电图特点为窦性 P波规则出现。PR间期恒定；正常或延长，无文氏现象。QRS波群部分脱落，房室传导比例常为3∶2、4∶3等（E错）。